下列穴位中治疗胎位不正应首选
A. 足窍阴
B. 厉兑
C. 至阴
D. 隐白
E. 大敦

正确答案：C。至阴

解析：至阴治疗胎位不正（C对）。足窍阴为井穴主治头痛、目赤肿痛、耳鸣耳聋等头面五官实热病证；胸胁痛，足跗肿痛（A错）。厉兑为井穴主治鼻衄、齿痛等实热性五官病证；热病；多梦、癫狂等神志疾患（B错）。隐白主治月经过多、崩漏等妇科病；出血性疾病等（D错）。大敦主治疝气，少腹痛；泌尿系疾病；月经病及前阴病等（E错）。